小儿开始更新恒牙的年龄是
A. 2～3岁
B. 4～5岁
C. 6～7岁
D. 8～9岁
E. 10岁

正确答案：C。6～7岁

解析：牙齿分为乳牙和恒牙两种，乳牙20个，恒牙28～32个，约自6个月起（4～10个月）乳牙开始萌出，6～7岁乳牙开始脱落换恒牙（C对）。2～3岁（A错）和4～5岁（B错）时小儿仍处于乳牙阶段。8～9岁（D错）和10岁（E错）时小儿已经处于更新恒牙阶段。